连于尖瓣与乳头肌之间的结构
A. 条索
B. 腱索
C. 节制索
D. 左、右束支
E. 房室束

正确答案：B。腱索

解析：腱索（B对）为连于尖瓣与乳头肌之间的结构，呈细索样。